可以引起人类呼吸道、胃肠道、泌尿道及眼部感染的病毒是
A. 呼吸道合胞病毒
B. 风疹病毒
C. 腮腺炎病毒
D. 腺病毒
E. 麻疹病毒

正确答案：D。腺病毒

解析：腺病毒（D对）可以引起人类呼吸道、胃肠道、泌尿道及眼部感染。呼吸道合胞病毒（A错）引发婴儿支气管炎、支气管肺炎。风疹病毒（B错）导致先天性耳聋、先天性心脏病、白内障、腮腺炎病毒（C错）引发流行性腮腺炎。麻疹病毒（E错）引发麻疹。